配制青霉素输液的适宜溶媒是
A. 50%葡萄糖注射液
B. 复方氯化钠注射液
C. 0.9%氯化钠注射液
D. 低分子右旋糖酐注射液
E. 5%葡萄糖注射液

正确答案：C。0.9%氯化钠注射液

解析：本题考查药物的适宜溶剂。青霉素的适宜溶媒是0.9%的氯化钠注射液（C对）。50%葡萄糖注射液（A错）主要用于组织脱水。复方氯化钠注射液（B错）不适宜作为溶解的溶媒。低分子量右旋糖酐注射液（D错）主要用于提高血液的胶体渗透压而扩充血容量。青霉素含β-内酰胺环，酸性较强的葡萄糖注射液（E错）可促进青霉素裂解。